一戴用全口义齿患者在做侧方咬合时，平衡侧基托翘动、脱落，其可能原因是
A. 正中颌不平衡
B. 侧方颌不平衡
C. 前伸颌不平衡
D. 垂直距离过高
E. 义齿固位差

正确答案：B。侧方颌不平衡

解析：全口义齿要求取得平衡（牙合），侧方运动时要求上下颌相关的牙都能同时接触，而平衡侧出现基托翘动，脱落，最可能的原因是侧方颌不平衡。掌握“全口义齿初戴”知识点。